把医患关系概括为“传统模式”和“人本模式”两种类型的是
A. 罗伯特-维奇
B. 布朗斯坦
C. 萨斯-荷伦德
D. 弗艾德
E. 迪肯

正确答案：B。布朗斯坦

解析：布朗斯坦在其编著的《行为科学在医学中的应用》一书中，把医患关系概括为“传统模式”和“人本模式”两种类型。掌握“医患沟通的理论、技术与其应用以及医患关系模式”知识点。